肾病综合征的中医证型，不包括的是
A. 湿热内蕴
B. 水湿浸渍
C. 肾阳衰微
D. 脾虚湿困
E. 风痰上扰

正确答案：E。风痰上扰

解析：肾病综合征是由脏腑功能失调、水液代谢失常等所致。湿热内蕴证（A对）、水湿浸渍证（B对）、肾阳衰微证（C对）、脾虚湿困证（D对）均是肾病综合征的常见中医证型。风痰上扰（E错，为本题正确答案）是癫痫的常见证型之一。